具噻唑烷酮结构，属PPAR-γ激动剂，近年来发现有致癌毒副作用的药物是
A. 格列齐特
B. 米格列奈
C. 二甲双胍
D. 盐酸吡格列酮
E. 米格列醇

正确答案：D。盐酸吡格列酮

解析：本题考查盐酸吡格列酮。盐酸吡格列酮（D对）为胰岛素增敏剂，为噻唑烷二酮结构，可特异性激活过氧化物酶增殖因子激活的γ型受体（PPAR-γ），增加骨骼肌、肝脏、脂肪组织对胰岛素的敏感性，改善胰岛素抵抗。格列齐特（A错）为磺酰脲类促胰岛素分泌药，通过刺激胰岛B细胞分泌胰岛素，增加体内胰岛素水平而降低血糖。米格列奈（B错）为非磺酰脲类促胰岛素分泌药。二甲双胍（C错）为双胍类降糖药，降糖机制为增加基础状态下糖的无氧酵解，抑制肠道内葡萄糖的吸收，增加葡萄糖的外周利用等。米格列醇（E错）能够可逆地竞争性抑制α-葡葡糖苷酶，减慢碳水化合物的水解以及葡萄糖的产生速度而降低餐后血糖。